关于素质发育特征的描述中哪项是错误的
A. 速度发育较早
B. 腰腹肌力量发育较早
C. 其后为下肢暴发力
D. 臂肌静止耐力发育比较晚
E. 耐力发育最晚

正确答案：E。耐力发育最晚